强直性脊柱炎特征性X线片变化
A. 脊椎呈“竹节”样
B. 骨膜反应呈三角形
C. 骨端膨胀呈肥皂泡样
D. 长管骨干骺区有骨性疣状突起
E. 有死骨形成并有包壳

正确答案：A。脊椎呈“竹节”样

解析：强直性脊柱炎是以骶髂关节和脊柱附着点炎症为主要病变的疾病，X线片示早期骶髂关节骨质疏松，关节边缘呈虫蚀状改变，间隙不规则增宽，软骨下骨有硬化致密改变，以后关节面渐趋模糊，间隙逐渐变窄，直至双侧骶髂关节完全融合。随病情发展椎间盘的纤维环和脊柱前、后纵韧带发生骨化，形成典型的“竹节样”脊柱（A对）。骨膜反应呈三角形（P777）（B错）为骨肉瘤的特征性表现。骨端膨胀呈肥皂泡样（P776）（C错）为骨巨细胞瘤的特征性表现。长管骨干骺区有骨性疣状突起（P774）（D错）为骨软骨瘤的特征性表现。有死骨形成并有包壳（P742）（E错）为慢性血源性骨髓炎的特征性表现。